自我意识的形成是在
A. 青少年期
B. 乳儿期
C. 婴儿期
D. 幼儿期
E. 学龄期

正确答案：A。青少年期

解析：青少年期认知能力发展主要表现在：高度发展的概括化观察力，思维具有抽象逻辑性，形成理论型的抽象思维能力，辩证思维发展，可形成活跃的创造性思维。计入记忆的最佳时期，具有成熟的记忆力；自我意识发展，自我意识形成。个性成熟，兴趣、性格趋于稳定，能力提高，道德意识和自控能力提高。掌握“不同年龄阶段心理卫生”知识点。